肠道杆菌中的鞭毛抗原是
A. O抗原
B. H抗原
C. K抗原
D. Vi抗原
E. S抗原

正确答案：B。H抗原

解析：肠道杆菌主要有菌体抗原（O抗原）、鞭毛抗原（H抗原）和荚膜抗原（K抗原或Vi抗原）。各菌种间可存在交叉抗原。掌握“肠道杆菌共性及埃希氏菌属”知识点。